在胶囊壳中加入的防腐剂是
A. 甘油
B. 尼泊金
C. 琼脂
D. 丙二醇
E. 二氧化钛

正确答案：B。尼泊金

解析：本题考查胶囊囊材。尼泊金（B对）在胶囊中可用于防腐剂，甘油、丙二醇常用作增塑剂，二氧化钛可用作遮光剂。